用HPLC测得两组分的保留时间分别为8.0和10.0min，峰宽分别为2.8和3.2mm，记录纸速5.0mm/min，则两峰的分离度为
A. 3.4
B. 3.3
C. 4
D. 1.7
E. 6.8

正确答案：B。3.3